下列各项，不属产后发热病因的是
A. 感染邪毒
B. 外感
C. 血瘀
D. 血虚
E. 阳盛血热

正确答案：E。阳盛血热

解析：产后血室正开，胞脉空虚，若产时接生不慎，或产后护理不洁，邪毒乘虚入侵直犯胞宫，正邪交争而发热。产后正虚，若邪毒炽盛，与血相搏，正虚邪盛则传变迅速，热入营血，甚则逆传心包，出现危急重证（A对）。产后气血骤虚，元气受损，腠理不密，卫阳不固，外邪乘虚而入，营卫不和，或正值暑令，卒中暑邪，亦可致发热（B对）。产后恶露不畅，当下不下，瘀血停滞，阻碍气机，营卫不通，郁而发热。（C对）。产时、产后失血过多，阴血骤虚，以致阳浮于外而发热；血虚伤阴，相火偏旺，亦致发热（D对）。阳盛血热是发热的一种类型，而不是产后发热的病因（E错，为本题正确答案）。